关于上颌侧切牙的描述正确的是
A. 唇面发育沟较上颌中切牙明显
B. 舌窝深而窄，为龋病的好发部位
C. 近中接触区距切角远，远中接触区距切角近
D. 切嵴向远中舌侧的倾斜度较上颌中切牙小
E. 牙根颈横切面为葫芦形

正确答案：B。舌窝深而窄，为龋病的好发部位

解析：上颌侧切牙：（1）唇面：牙冠较窄小、圆突，发育沟不如上颌中切牙明显。（2）舌面：舌窝深而窄，偶有沟越过舌隆突的远中，延伸至根颈部成为裂沟，成为龋病的好发部位。（3）邻面：近远中接触区均在切1/3，距切角的距离较中切牙稍远，其中近中接触区距切角近，远中接触区距切角稍远。（4）切嵴：向远中舌侧的倾斜度较上颌中切牙大，似与远中面连续。（5）牙根：亦为单根，颈横切面为卵圆形。掌握“上下颌前牙的外形及临床应用解剖”知识点。